当肝门静脉高压症时脐周静脉网血流与体循环静脉相交通途径是
A. 奇静脉
B. 脐静脉
C. 附脐静脉
D. 副半奇静脉
E. 均不是

正确答案：C。附脐静脉

解析：附脐静脉（C对）为肝门静脉高压症时脐周静脉网血流与体循环静脉相交通途径。